乳癖证属于冲任失调的临床表现为
A. 乳房胀痛
B. 经前加重
C. 腰膝酸软
D. 失眠多梦
E. 脘胀纳呆

正确答案：B、C。经前加重；腰膝酸软

解析：本题考查的是乳癖的辨证论治。乳癖证属于冲任失调的临床表现为经前加重（B对）与腰膝酸软（C对）。乳癖，是乳腺组织的既非炎症也非肿瘤的良性增生性疾病。临床特点是单侧或双侧乳房疼痛并出现肿块，乳痛和肿块与月经周期及情志变化密切相关。乳房肿块大小不等，形态不一，边界不清，质地不硬，活动度好。常见于中青年妇女，是临床最常见的乳房疾病。西医学的乳腺小叶增生、乳房囊性增生等疾病表现为上述症状者，可参考此内容辨证论治。（一）肝郁痰凝证：【症状】多见于青壮年妇女。乳房肿块，质韧不坚，胀痛（A错）或刺痛，症状常随喜怒消长；伴胸闷胁胀，善郁易怒，失眠多梦（D错），心烦口苦。舌苔薄黄，脉弦滑。（二）冲任失调证：【症状】多见于中年妇女。乳房肿块月经前加重，经后缓解；伴腰膝酸软，神疲倦怠，月经失调，量少色淡，或闭经。舌质淡，苔白，脉沉细。脘胀纳呆（E错）为月经过少脾虚证的症状。月经过少脾虚证：【症状】经来先后无定，经量多，色淡质稀，神倦乏力，脘腹胀满，纳呆食少。舌淡，苔薄，脉缓。